与克拉维酸合用可抑制β-内酰胺酶以提高疗效
A. 异烟肼
B. 亚胺培南
C. 沙丁胺醇
D. 阿莫西林
E. 氨苯蝶啶

正确答案：D。阿莫西林

解析：本题考查药物的联合应用。阿莫西林（D对）易被细菌的β内酰胺酶水解，克拉维酸是β内酰胺酶不可逆的竞争型抑制剂，故阿莫西林与克拉维酸组成复方制剂阿莫西林克拉维酸钾，可以提高抗菌活性和效果。异烟肼（A错）为治疗结核病的首选药物。亚胺培南（B错）是碳青霉烯类抗生素。沙丁胺醇（C错）是治疗哮喘急性发作的首选用药。氨苯蝶啶（E错）用于治疗各类水肿。